供清洗或涂抹无破损皮肤或腔道用的液体制剂是
A. 洗剂
B. 糊剂
C. 酊剂
D. 搽剂
E. 贴剂

正确答案：A。洗剂

解析：本题考查洗剂。洗剂（A对）是含原料药的溶液、乳状液、混悬液，供清洗或涂抹无破损皮肤或腔道用的液体制剂。